对高三酰甘油血症者应首选的血脂调节药是
A. 羟甲戊二酰辅酶A还原酶抑制剂
B. 烟酸缓释剂
C. 胆酸螯合剂
D. 贝丁酸类
E. 脂酶抑制剂

正确答案：D。贝丁酸类

解析：本题考查调血脂药。高三酰甘油血症首选贝特类即贝丁酸类（D对）。羟甲戊二酰辅酶A还原酶抑制剂（A错）是高总胆固醇血症者首选的血脂调节药。烟酸缓释剂（B错）、胆酸螯合剂（C错）、脂酶抑制剂（E错）均不是高三酰甘油血症首选药。